关于吉非替尼作用特点、适应证及不良反应的说法，正确的有
A. 可用于晚期或转移性非小细胞肺癌
B. 常见不良反应为皮疹、腹泻、转氨酶或胆红素升高
C. 可用于晚期或转移性小细胞肺癌
D. 可用于慢性粒细胞白血病
E. 主要经CYP3A4代谢

正确答案：A、B、E。可用于晚期或转移性非小细胞肺癌；常见不良反应为皮疹、腹泻、转氨酶或胆红素升高；主要经CYP3A4代谢

解析：本题考查吉非替尼。吉非替尼用于治疗非小细胞肺癌和转移性非小细胞肺癌（A对CD错），常见不良反应为皮疹、腹泻、转氨酶或胆红素升高（B对）。吉非替尼主要经CYP3A4代谢（E对），与CYP3A4抑制剂联合应用，可使吉非替尼的药-时曲线下面积增加。